下列中不属于大气污染物内暴露指标的是
A. 血中碳氧血红蛋白
B. 尿氟
C. 尿羟脯氨酸
D. 血NO血红素
E. 血铅

正确答案：C。尿羟脯氨酸

解析：本题考查大气污染物的内暴露指标。内暴露剂量是指在过去一段时间内机体已吸收至人体内的污染物量。可以通过测定内暴露指标来确定内暴露剂量。血中碳氧血红蛋白（A对）、尿氟（B对）、血NO血红素（D对）、血铅（E对）均属于大气污染物的内暴露指标。尿羟脯氨酸(C错，为本题正确答案)不属于大气污染物内暴露指标。